国家对艾滋病实行以下哪项制度
A. 自愿咨询制度
B. 自愿检测制度
C. 自愿治疗制度
D. 自愿咨询和自愿检测制度
E. 自愿检测和自愿治疗制度

正确答案：D。自愿咨询和自愿检测制度

解析：国家目前实行艾滋病的自愿咨询和自愿检测的制度。掌握“艾滋病的预防与控制、治疗与法律责任”知识点。